患者，男，60岁，因轻度冻疮（无破溃）到药店购药，药师应推荐的药品是
A. 利巴韦林软膏
B. 特比萘芬乳膏
C. 10%樟脑软膏
D. 氢化可的松软膏
E. 红霉素软膏

正确答案：C。10%樟脑软膏

解析：本题考查轻度冻疮的用药。轻度冻疮患者，可选用10%樟脑软膏（C对）、肌醇烟酸酯软膏、10%辣椒软膏、10%氧化锌软膏或冻疮膏等涂敷患部，进行治疗。红霉素软膏（E错）用于严重冻疮合并严重感染者。特比萘芬乳膏（B错）可用于治疗水疱型足癣。利巴韦林软膏（A错）是抗病毒药，用于单纯疱疹病毒性角膜炎。氢化可的松软膏（D错）属于糖皮质激素类软膏，用于治疗亚急性、慢性湿疹。